紫外线对皮肤作用最强的波长是
A. 400nm
B. 320nm
C. 275nm
D. 297nm
E. 180nm

正确答案：D。297nm

解析：本题考查紫外线对皮肤的作用。皮肤对紫外线的吸收，随波长而异。波长在200㎚以下，几乎全被角质层吸收；波长在220～330㎚间，可被深部组织吸收。强烈紫外线辐照可引起皮炎，表现为红斑，有时伴有水泡和水肿。接触300㎚波段，可引起皮肤灼伤，其中297㎚（D对ABCE错）的紫外线对皮肤的作用最强，可引起皮肤红斑并残留色素沉着。